氨基苷类抗生素+骨骼肌松弛药
A. 增加肾毒性
B. 增加耳毒性
C. 延缓耐药性产生
D. 增强抗菌范围
E. 增加神经-肌肉接头阻滞

正确答案：E。增加神经-肌肉接头阻滞